患者，男性，28岁，农民。因在田间喷洒农药，突然晕倒在地，急诊入院。查体：血压135/94mmHg，语言不清，瞳孔缩小，对光反应消失，多汗，流涎，全身抽搐。急性中毒治疗原则是
A. 及时使用复能剂
B. 阿托品使用原则是及时、足量、重复给药
C. 清除体内毒物
D. 保持呼吸道通畅
E. 以上均正确

正确答案：E。以上均正确